根据《医疗机构制剂配制质量管理规范（试行）》，制剂配发记录的内容不包括
A. 领用部门
B. 配置日期
C. 制剂名称
D. 批号
E. 数量

正确答案：B。配置日期

解析：本题考查的是医疗机构配制制剂在使用管理方面的质量管理。根据《医疗机构制剂配制质量管理规范（试行）》，制剂配发记录的内容不包括配置日期（B错，为本题正确答案）。医疗机构配制制剂在使用管理方面的质量管理：制剂配发必须有完整的记录或凭据。内容包括：领用部门（A对）、制剂名称（C对）、批号（D对）、规格、数量（E对）等。制剂在使用过程中出现质量问题时，制剂质量管理组织应及时进行处理，出现质量问题的制剂应立即收回，并填写收回记录。收回记录应包括：制剂名称、批号、规格、数量、收回部门、收回原因、处理意见及日期等。制剂使用过程中发现的不良反应，应按《药品不良反应报告和监测管理办法》的规定予以记录，填表上报。保留病历和有关检验、检查报告单等原始记录至少一年备查。